地西泮的活性代谢产物制成的药品是
A. 硝西泮
B. 奥沙西泮
C. 劳拉西泮
D. 氯硝西泮
E. 氟地西泮

正确答案：B。奥沙西泮

解析：本题考查苯二氮䓬类药物地西泮。地西泮的活性代谢产物制成的药品是奥沙西泮（B对）。镇静催眠药地西泮羰基的α-碳原子经代谢羟基化后生成替马西泮或发生N-脱甲基和α-碳原子羟基化代谢生成奥沙西泮，两者均为活性代谢产物。氯硝西泮（D错）和硝西泮（A错）为苯二氮䓬A环上7位引入了吸电子的硝基，活性明显增强。氟地西泮（E错）为C环上的5位苯环上的2′位引入体积小的吸电子基团F，可使活性增强。劳拉西泮（C错）是由地西泮C环上2位引入卤素原子得到的，药物活性更强。